患者咳嗽痰多，痰白青稀，食少便溏，近日下肢轻度浮肿，舌淡苔白，脉弱。治疗应选用
A. 党参
B. 薏苡仁
C. 山药
D. 白术
E. 黄精

正确答案：D。白术

解析：患者咳嗽痰多，痰白清稀，食少便溏，为肺脾气虚；下肢轻度水肿，为脾气虚所致，因此应当选用健脾益气，燥湿利水的白术（D对）。党参（A错）的功效是补脾益肺，养血生津。薏苡仁（B错）的功效是利水渗湿，健脾止泻，除痹，清热排脓。由于薏苡仁淡渗利湿，健脾益气的功效弱于白术。所以这题最佳选项为白术。山药（C错）的功效是补脾养胃，生津益肺，补肾涩精。黄精（E错）的功效是补气养阴，健脾润肺益肾。